男，46岁，入院经检查为癌前病变，需行手术治疗。患者得知病情后，心慌、乏力、头晕，医师做患者和患者家属的工作，征得患者及家属同意后，准备手术。准备手术前需进行术前签字，签字者应为下列
A. 患者本人
B. 患者妻子
C. 患者已成年子女
D. 患者兄弟姐妹
E. 患者父母

正确答案：A。患者本人

解析：医疗机构在施行手术时，应向患者作必要解释，征得同意后取得其签字方可实施(A对），若无法取得患者意见，应征得其家属或者关系人同意及签字，若无家属及关系人，或遇到特殊情况时，在取得医疗结构负责人或者被授权负责人的批准后方可实施｡